男，65岁。15小时前因咳嗽而突发右下腹剧烈疼痛，右侧阴囊亦肿胀疼痛。右侧腹股沟区呈梨形隆起，不能回纳。行急诊手术治疗，术中发现嵌顿的肠管已坏死，应采取的手术方法是
A. 无张力疝修补术
B. 疝囊高位结扎术
C. Bassini修补术
D. 疝成型术
E. Ferguson修补术

正确答案：B。疝囊高位结扎术

解析：老年男性患者，因咳嗽而突发右下腹剧烈疼痛，右侧腹股沟区呈梨形隆起（提示腹股沟疝），右侧阴囊肿胀疼痛（提示疝囊进入阴囊），结合患者病史、症状和体征，应诊断为右侧腹股沟斜疝。急诊手术中，发现嵌顿的肠管已坏死，提示已进展为绞窄性疝。因此，应采取的手术方法是单纯疝囊高位结扎术（B对），而不宜作疝修补术，以免因感染而致修补失败。无张力疝修补术（A错）、Bassini修补术（C错）、Ferguson修补术（E错）均不适用于绞窄性疝。疝成型（形）术（七版黄家驷外科学P1278）（D错）适用于腹股沟管后壁缺损严重、周围组织纤弱的巨大腹股沟疝的病人，不能用于该患者。